开展多种形式的交流活动，融洽师生关系，属于学校健康社会环境的
A. 事物环境
B. 人际环境
C. 社区环境
D. 物质环境
E. 教育环境

正确答案：B。人际环境